属于贝丁酸类调节血脂药的是
A. 阿托伐他汀
B. 非诺贝特
C. 阿昔莫司
D. 依折麦布
E. 烟酸

正确答案：B。非诺贝特

解析：本题考查调血脂药。属于贝丁酸类调节血脂药的是非诺贝特（B对）。调血脂药分类：1.羟甲基戊二酰辅酶A还原酶抑制剂（他汀类），如阿托伐他汀（A错）、辛伐他汀、氟伐他汀等。2.胆汁酸结合树脂，如考来烯胺等。3.贝丁酸类，如非诺贝特、苯扎贝特等。4.烟酸类，如烟酸（E错）、阿昔莫司（C错）等。5.胆固醇吸收抑制剂：如依折麦布（D错）等。6.多烯脂肪酸类，如二十碳五烯酸（EPA）等。